仅含一种类型核酸的病原体是
A. 单纯疱疹病毒
B. 结核分枝杆菌
C. 衣氏放线菌
D. 沙眼衣原体
E. 白假丝酵母菌

正确答案：A。单纯疱疹病毒

解析：仅含一种类型核酸的微生物为非细胞型微生物，核酸类型为DNA或RNA，两者不同时存在，单纯疱疹病毒（A对）为病毒，属于此类微生物。结核分枝杆菌（B错）为细菌，衣氏放线菌（C错）为放线菌，沙眼衣原体（D错）为衣原体，均属于原核细胞型微生物，DNA与RNA会同时存在，有两种核酸。白假丝酵母菌（E错）为真菌，属于真核细胞型微生物，DNA与RNA会同时存在，有两种核酸。